阿片类药物中毒拮抗的药物
A. 阿扑吗啡
B. 尼可刹米
C. 纳洛酮
D. 烯丙吗啡
E. 维库溴铵

正确答案：C、D。纳洛酮；烯丙吗啡

解析：本题考查阿片类药物中毒解救。阿片类药物中毒拮抗的药物是纳洛酮（C对）和烯丙吗啡（D对）。纳洛酮和烯丙吗啡的化学结构与吗啡相似，但与阿片受体的亲和力大于阿片类药物，能阻止吗啡样物质与受体结合，从而消除吗啡等药物引起的呼吸和循环抑制等症状。阿扑吗啡（A错）用于抢救意外中毒及不能洗胃的患者；常用于治疗石油蒸馏液吸入患者，如煤油、汽油、煤焦油、燃料油或清洁液等，以防止严重的吸入性肺炎。尼可刹米（B错）用于中枢性呼吸抑制及各种原因引起的呼吸抑制。维库溴铵（E错）是一种全麻辅助药，主要在全麻时候的气管插管和肌肉松弛使用。